对下腔静脉的描述不正确的是
A. 全身最大静脉干
B. 位于腹后壁
C. 沿脊柱右前方及主动脉腹部的右侧上行
D. 于第8胸椎高度穿膈肌腔静脉孔入胸腔
E. 于第4腰椎水平由左、右髂外静脉汇合而成

正确答案：E。于第4腰椎水平由左、右髂外静脉汇合而成

解析：下腔静脉全身最大静脉干（A对）。位于腹后壁（B对）。沿脊柱右前方及主动脉腹部的右侧上行（C对）。于第8胸椎高度穿膈肌腔静脉孔入胸腔（D对）。于第4腰椎水平由左、右髂总静脉（E错，为本题正确答案）汇合而成。